学生健康监测每一性别年龄组的监测人数不应少于
A. 200人
B. 300人
C. 400人
D. 500人
E. 600人

正确答案：B。300人